发生钙化不全的牙齿随着日常磨耗，常磨至牙齿哪个部位
A. 近中1/3
B. 远中1/3
C. 近牙冠1/3
D. 牙冠中1/3
E. 牙颈部

正确答案：E。牙颈部

解析：本题考查釉质形成缺陷（釉质发育不全）。牙釉质钙化不全的牙齿萌出时大小、形态、釉质厚度正常，但是釉质很软，因磨耗而很快磨去，常磨至牙颈部（E对），仅遗留颈部牙釉质，因颈部釉质钙化较高。